既增加降压效果，又减少不良反应的是
A. 磺胺类药+甲氧苄啶
B. 棒酸+阿莫西林
C. 依那普利+利尿药
D. 亚胺培南+西拉司丁
E. 氟尿嘧啶+四氢叶酸

正确答案：C。依那普利+利尿药

解析：本题考查药物的联合应用。既增加降压效果，又减少不良反应的是依那普利+利尿药（C对）。依那普利为竞争性血管紧张素转换酶抑制剂，阻断血管紧张素Ⅰ转化为血管紧张素Ⅱ，从而降低血压，与利尿药氢氯噻嗪合用，有协同的降压作用，明显增加降压作用，剂量比各自单用时减少。磺胺类药+甲氧苄啶（A错）对细菌叶酸代谢呈双重阻断作用。棒酸+阿莫西林（B错）可抑制β内酰胺酶，对耐药菌株有效。亚胺培南属于碳青霉烯抗生素，具有抗菌谱广、对各种β-内酰胺酶稳定、抗菌活性较β-内酰胺类强等特点。但该药在体内被肾小管细胞的二肽酶灭活。西司他丁是二肽酶的抑制剂，可保护亚胺培南，防止其在肾中被破坏，从而保持其体内活性（D错）。氟尿嘧啶+四氢叶酸（E错）可增加药物与TMPS酶结合，使抗癌效果增强。